以下关于医患关系的叙述中，正确的是
A. 昏迷病人和医生间的医患关系属指导-合作型
B. 病人可提出自己的要求和建议，医生应绝对服从病人的意愿
C. 随着病情变化，可由一种模式转向另一种模式
D. 休克病人和医生间的医患关系属指导-合作型
E. 病人应遵从医生的安排

正确答案：C。随着病情变化，可由一种模式转向另一种模式

解析：随着病情变化，医患模式可进行转化。掌握“医患沟通的理论、技术与其应用以及医患关系模式”知识点。